嘶哑样咳嗽，可见于
A. 急性喉炎
B. 肺结核
C. 百日咳
D. 胸膜炎
E. 支气管扩张

正确答案：A。急性喉炎

解析：咳嗽的音色对提示诊断有一定的意义。嘶哑样咳嗽，可见于声带炎、喉炎（A对）、喉癌，以及肺癌、扩张的左心房或主动脉瘤压迫喉返神经。肺结核（B错）时的咳嗽，为夜间明显，这可能与夜间肺淤血加重及迷走神经兴奋性增高有关。百日咳（C错）是一种由百日咳杆菌引起的急性呼吸道传染病，临床特征为咳嗽逐渐加重，呈典型的阵发性、痉挛性咳嗽，咳嗽终末出现深长的鸡啼样吸气性吼声。胸膜炎（D错）较少咳嗽，主要的表现为与呼吸运动有关的胸部疼痛。支气管扩张（E错）时，可有咳嗽和大量脓痰，咳嗽的特点是体位改变时咳嗽加剧。